男，52岁。上腹部疼痛反复发作5年，近7天出现腹胀，呕吐。经X线钡餐检查诊断十二指肠溃疡伴幽门梗阻。最适宜的手术方式是
A. 毕Ⅰ式胃大部切除术
B. 毕Ⅱ式胃大部切除术
C. 胃空肠吻合术
D. 迷走神经干切断术
E. 选择性胃迷走神经切断术

正确答案：B。毕Ⅱ式胃大部切除术

解析：中年男性患者，确诊为十二指肠溃疡伴幽门梗阻，手术治疗应选择胃大部切除术。由于十二指肠溃疡患者的基础胃酸分泌较多，行胃大部切除术时，胃切除量较多，为了避免术后吻合口张力过大导致吻合口漏，该患者最适宜的手术方式是毕Ⅱ式胃大部切除术（B对）。毕Ⅰ式胃大部切除术（A错）吻合口张力较高，不适用于该患者。如果仅做胃空肠吻合术，不做胃大部切除术，仅能解决幽门梗阻问题，术后胃酸仍然很高，十二指肠溃疡不会愈合（C错）。迷走神经干切断术（D错）、选择性胃迷走神经切断术（E错）不能解除幽门梗阻，且术后并发症较多，溃疡易复发，现已少用。